女性，28岁，主诉：半年来全口牙龈逐渐肿大，刷牙出血。对患者的治疗措施不正确的是
A. 牙周基础治疗
B. 全身应用抗生素
C. 去除局部刺激因素
D. 尽量在分娩后切除
E. 必要时在妊娠4～6个月间进行手术

正确答案：B。全身应用抗生素

解析：考查的是妊娠期龈炎的治疗原则，对妊娠期龈炎患者不应用全身抗生素治疗。掌握“妊娠期龈炎”知识点。